男婴，三天。出生后不吃、不哭、不动，少尿，体温不升，胎龄32周早产。查体：T34℃，呼吸不规则，反应低下，皮肤黄染，肺部呼吸音低，心音低钝，腹胀，面颊、臀部，双下肢皮肤硬肿，压之凹陷，手足凉。最可能的诊断是
A. 新生儿黄疸
B. 新生儿肺炎
C. 新生儿心肌炎
D. 新生儿水肿
E. 新生儿寒冷损伤综合症

正确答案：E。新生儿寒冷损伤综合症

解析：患婴，早产儿，出生3天，不吃、不哭、不动、反应低下，体温低（早产儿体温调节中枢不成熟，皮下脂肪少，皮肤薄），并有双下肢、臀部、面颊皮肤硬肿的表现（皮下脂肪低体温时易于凝固），根据患儿早产史、临床表现及体征，应诊断为新生儿寒冷损伤综合症（E对）。新生儿黄疸（A错）约有85%的足月儿和绝大多数早产儿在新生儿期均有暂时性总胆红素升高。双肺未闻及湿啰音，排除新生儿肺炎（B错）。新生儿心肌炎临床表现不典型，而该患儿没有支持心肌炎诊断的临床表现及实验室检查（C错），新生儿水肿（D错）多由其他病因引起，出生后因各种原因引起的新生儿水肿多见于四肢、腰背、颜面和会阴部。